血清总胆红素、结合胆红素、非结合胆红素均中度增加。可见于
A. 蚕豆病
B. 胆石症
C. 珠蛋白生成障碍性贫血
D. 急性黄疸性肝炎
E. 胰头癌

正确答案：D。急性黄疸性肝炎

解析：急性黄疸性肝炎可出现肝细胞严重损害，从而导致部分肝细胞对胆红素的摄取、结合功能障碍，因而血清非结合胆红素增加。同时，由于肿胀的肝细胞及炎性细胞浸润压迫毛细胆管和胆小管，从而使胆汁排泄受阻，胆汁反流入血循环，引起血清结合胆红素、血清总胆红素增加（D对）。蚕豆病（A错）、珠蛋白生成障碍性贫血（C错）主要引起溶血性黄疸，表现为血清总胆红素可增加、血清结合胆红素基本正常、血清非结合胆红素明显增加。胆石症（B错）、胰头癌（E错）主要引起胆汁淤积性黄疸，表现为血清总胆红素增加、血清结合胆红素明显增加、血清非结合胆红素基本正常。